与二、三级信息源相比一级信息源的特点是
A. 如果是单一临床试验得到的信息，其结果或结论有可能是错误的，可能会误导读者
B. 一级信息源提供的信息比二级和三级信息源的内容更新
C. 要求读者具有对药学或医学文献进行评价的能力
D. 阅读大量的一级文献要花费许多的时间
E. 对一个具体问题所提供的信息简明扼要

正确答案：B。一级信息源提供的信息比二级和三级信息源的内容更新

解析：本题考查一级信息的特点。一级信息源提供的信息比二级和三级信息源的内容更新（B对）。如果是单一临床试验得到的信息，其结果或结论有可能是错误的，可能会误导读者（A错）、要求读者具有对药学或医学文献进行评价的能力（C错）、阅读大量的一级文献要花费许多的时间（D错）为一级信息源相对于二、三级信息源的缺点；对一个具体问题所提供的信息简明扼要（E错）属于三级信息源的特点。